含三氮唑结构的抗真菌药物是
A. 氟康唑
B. 克霉唑
C. 来曲唑
D. 利巴韦林
E. 阿昔洛韦

正确答案：A。氟康唑

解析：本题考查抗真菌药。氟康唑（A对）为三氮唑类抗真菌药物，含三氮唑结构。来曲唑（C错）为抗肿瘤药。利巴韦林（D错）为抗病毒药。克霉唑（B错）含咪唑结构。阿昔洛韦（E错）为抗病毒药物。